既往的牙髓治疗失败，或感染根管的根尖病变未得到控制，临床上需要
A. 根尖诱导成形术
B. 根管治疗
C. 间接盖髓
D. 根管再治疗
E. 根面平整术

正确答案：D。根管再治疗

解析：既往的牙髓治疗失败，非感染根管患牙出现根尖病变，或感染根管的根尖病变未得到控制，临床上需要重新进行根管治疗（根管再治疗）。掌握“根管治疗术概述”知识点。